抗癫痫的药是
A. 酮康唑
B. 培哚普利
C. 利多卡因
D. 法莫替丁
E. 卡马西平

正确答案：E。卡马西平

解析：本题考查抗癫痫药。卡马西平（E对）为抗癫痫药。酮康唑（A错）为广谱抗真菌药。培哚普利（B错）用于治疗各种高血压与充血性心力衰竭。利多卡因（C错）仅用于室性心律失常。法莫替丁（D错）为组胺H₂受体阻断剂，可抑制胃酸分泌。